手太阳小肠经的郄穴是
A. 小海
B. 支正
C. 后溪
D. 腕骨
E. 养老

正确答案：E。养老

解析：养老为手太阳小肠经郄穴（E对）。小海为手太阳小肠经合穴（A错）。支正为手太阳小肠经络穴（B错）。后溪为手太阳小肠经输穴；八脉交会穴（C错）。腕骨为手太阳小肠经原穴（D错）。